某患者因左下第一磨牙急性根尖脓肿造成左下颌骨急性中央性骨髓炎，疼痛剧烈，左侧前磨牙及磨牙松动，牙龈红肿，龈袋溢脓，以下治疗措施中，不正确的是
A. 给予足量、有效的抗生素
B. 局部超短波理疗
C. 拔除左下第一磨牙，其余松动牙尽量保留
D. 若引流不畅，可考虑凿去部分骨外板
E. 形成骨膜下脓肿时应尽早切开引流

正确答案：C。拔除左下第一磨牙，其余松动牙尽量保留

解析：急性颌骨骨髓炎在治疗过程中应首先注意全身治疗，同时应配合外科手术治疗。（1）应根据临床反应、细菌培养及药物敏感试验的结果，给予足量、有效的抗生素，以控制炎症的发展。物理疗法对急性炎症初期，可收到一定效果，如用超短波，能缓解疼痛，达到使肿胀消退以及促使炎症局限的目的。（2）外科治疗：外科治疗的目的是引流排脓及除去病灶。在急性中央性颌骨骨髓炎，一旦判定骨髓腔内有化脓性病灶时，即应及早拔除病灶牙及相邻的松动牙；如经拔牙，未达到引流目的，症状也不减轻时，则应考虑凿去部分骨外板，以达到敞开髓腔充分排脓。如果形成骨膜下脓肿，单纯拔牙引流已无效，此时，可根据脓肿的部位先从下颌下切开引流，待炎症好转，张口度有改善后，再行拔牙。掌握“颌骨骨髓炎”知识点。